虚寒证的临床表现为
A. 面色㿠白
B. 神疲乏力
C. 舌质淡嫩
D. 脉沉迟无力
E. 头身疼痛

正确答案：A、B、C、D。面色㿠白；神疲乏力；舌质淡嫩；脉沉迟无力

解析：本题考查的是虚寒证的临床表现及辨证要点。虚寒证的临床表现为面色㿠白（A对）、神疲乏力（B对）、舌质淡嫩（C对）与脉沉迟无力（D对）。虚寒证即阳虚证。阳虚证的临床表现，除见神疲乏力、少气懒言、蜷卧嗜睡、脉微无力等气虚功能衰减的症状外，还常兼见畏寒肢冷、口淡不渴、尿清便溏或尿少肿胀、面白舌淡等阳不制阴、水寒内盛的症状。头身疼痛（E错）为表证的临床表现。表证，指的是病位浅在肌肤的一类证候。一般是指六淫之邪从皮毛、口鼻侵入人体而引起的外感病初起阶段。其临床表现以发热恶寒，或恶风，舌苔薄白，脉浮为主。常兼见头身疼痛、鼻塞、咳嗽等症状。以起病急、病程短、有发热恶寒的症状为辨证要点。